男4岁，因怀疑先天性心脏病就诊。该患儿口唇粘膜青紫，轻度杵状指趾，胸骨左缘2～4肋间听到2～3级收缩期杂音，肺动脉第二音减弱；为确诊应做的检查是
A. 脑电图
B. 头部CT
C. 心肌酶谱
D. 右心导管造影
E. 腹部B超

正确答案：D。右心导管造影

解析：患儿，胸骨左缘2-4肋间可听到2-3级收缩期杂音、肺动脉第二音减弱，以及伴有青紫和杵状指趾得临床表现，可判断该患儿为法洛四联症，为明确诊断应选择右心导管造影（D对）。对先天性心脏病诊断有帮助的是心电图而不是脑电图（A错）。该患儿是怀疑为先天性心脏病（心脏方面的疾病），头部CT（B错）和腹部B超（E错）对诊断当然没有作用，属于无关干扰项。心肌酶谱是用于确诊心肌坏死，而不是先天性心脏病（C错）。